谷类是哪种维生素的重要来源
A. 抗坏血酸
B. B族维生素
C. 维生素A
D. 维生素D
E. 维生素C

正确答案：B。B族维生素